呼气性呼吸困难常见于
A. 急性喉炎
B. 气管异物
C. 支气管哮喘
D. 肺炎球菌肺炎
E. 喉头水肿

正确答案：C。支气管哮喘

解析：本题考查支气管哮喘的临床表现。呼气性呼吸困难常见于支气管哮喘（C对）。急性喉炎（A错）、气管异物（B错）、喉头水肿（E错）可发生吸气性呼吸困难，主要特点表现为吸气显著费力，严重者吸气时可见“三凹征”，常见于喉部、气管、大气广德狭窄与堵塞。肺炎球菌肺炎（D错）早期肺部体征无明显异常，仅有胸廓呼吸运动幅度减小，叩诊稍浊，听诊可有呼吸音减低及胸膜摩擦音；肺实变时叩诊浊音，触觉语颤增强并可闻及支气管呼吸音；消散期可闻及湿啰音；一般不会出现呼吸困难。